女性，22岁，因右下智齿低位埋伏阻生，要求拔除。在麻醉过程中病人发生晕厥，以下处理措施哪项是错误的
A. 立即停止注射
B. 置病人于头低位，解开颈部衣扣
C. 嗅闻氨水
D. 吸氧
E. 静脉推注肾上腺素

正确答案：E。静脉推注肾上腺素

解析：本题考查晕厥的防治措施。静脉推注肾上腺素（E错，为本题的正确答案），肾上腺素进入血管内肾上腺素浓度上升，可因血压骤升而发生脑出血或心脏过度兴奋引起心率失常等不良反应，会引起新的并发症加重晕厥。晕厥为局麻并发症之一，是一种突发性、暂时性意识丧失。通常是由于一时性中枢缺血所致。一般可因恐惧、饥饿、疲劳及全身健康较差、疼痛以及体位不良等因素所引起。在局麻过程中病人发生晕厥，应立即停止注射（A对），以防发生严重反应；置病人于头低位，解开颈部衣扣（B对），以保持呼吸道通畅；嗅闻氨水（C对），以刺激呼吸；吸氧（D对）以保证机体供氧需求，以防二氧化碳中毒。